小儿重度蛋白质能量营养不良饮食调整治疗每日约
A. 80～100Kcal/kg
B. 60～80Kcal/kg
C. 40～60Kal/kg
D. 20～40Kcal/kg
E. 10～20Kcal/kg

正确答案：C。40～60Kal/kg

解析：小儿重度蛋白质能量营养不良饮食调整治疗每日约40～60Kcal/kg。营养不良患儿的消化道因长期摄入过少，已适应了低营养的摄入，过快过量的摄食会加重消化道的负担，出现消化不良，腹泻等情况。因此小儿蛋白质能量营养不良饮食调整治疗应循序渐进，轻度营养不良可略微多摄入能量从60～80Kcal/kg（B错）开始，中、重度则应该应从更少的40～60Kcal/kg（C对）开始，逐步少量增加；若消化能力较好，可逐渐增加到120～170Kcal/kg，以满足患儿的追赶性生长。